与碳酸氢钠、氧化镁等碱性药合用，引起尿液变色的泻药是
A. 甘油
B. 聚乙二醇4000
C. 乳果糖
D. 硫酸镁
E. 酚酞

正确答案：E。酚酞

解析：本题考查酚酞。与碳酸氢钠、氧化镁等碱性药合用，引起尿液变色的泻药是酚酞（E对），酚酞遇碱变红。甘油（A错）为润滑性泻药，用于年老体弱者便秘的治疗。聚乙二醇4000（B错）为治便秘药，用于缓解成人便秘的症状。乳果糖（C错）是一种渗透性泻药，用于治疗慢性功能性便秘。硫酸镁（D错）为抗惊厥药。